抗破伤风抗毒素细胞来源
A. 单克隆 B 细胞
B. 单克隆 T 细胞
C. NK 细胞
D. 多克隆 B 细胞
E. 多克隆 T 细胞

正确答案：D。多克隆 B 细胞

解析：抗破伤风抗毒素细胞来源多克隆 B 细胞（D对）。多克隆抗体、单克隆抗体和基因工程是人工制备抗体的主要方法。多克隆抗体主要作为第二抗体与单克隆抗体联用。单克隆抗体研究蛋白质结构和功能。基因工程抗体以人源化抗体为主，适合于体内诊断和治疗。